患者，女，35岁。下痢赤白粘冻2月余，白多赤少，伴腹痛，里急后重，纳食无味，腹胀，头身困重，舌淡苔白腻，脉濡数。粪便镜检：白细胞15～20个/高倍视野。治疗应首选
A. 芍药汤
B. 白头翁汤
C. 胃苓汤
D. 驻车丸
E. 桃花汤

正确答案：C。胃苓汤

解析：寒湿为阴邪，阴邪留于肠中，则气机阻滞，传导失常，故见下痢赤白粘冻2月余；寒湿伤于气分，故见白多赤少；气机郁滞故见伴腹痛，里急后重；寒湿中阻，运化失常则纳食无味，腹胀；脾主肌肉而健运四旁，寒湿困脾则健运失司，故见头身困重；舌淡苔白腻，脉濡数，皆为寒湿困脾证，治疗需除湿散寒，健脾理中，方药选用胃苓汤加减（C对）。芍药汤（A错）可以清热利湿，凉血止痢，用于治疗湿热内蕴证。白头翁汤（B错）可以清热解毒，行气活血，用于治疗热毒痢疾。驻车丸（D错）可以滋阴养血，清热化湿，用于治疗阴血亏虚证。桃花汤（E错）可以温中涩肠，行气止利，用于治疗虚寒血痢证。